关于遗传性乳光牙本质的病理表现，说法错误的是
A. 罩牙本质结构正常
B. 牙本质内小管数目减少
C. 牙本质小管方向紊乱
D. 牙本质小管形态规则
E. 牙本质基质可见小球间钙化

正确答案：D。牙本质小管形态规则

解析：遗传性乳光牙本质的病理变化表现为近釉质的一薄层罩牙本质结构正常，但其余牙本质结构改变。牙本质内小管数目减少，方向紊乱，许多小管形态不规则、管径变大，并存在无小管的牙本质区。牙本质基质可呈颗粒状，并见小球间钙化。掌握“氟牙症、先天性梅毒牙与牙本质形成缺陷”知识点。